对眼睛有刺激性，不宜用作眼膏基质的是
A. 二甲硅油
B. 蜂蜡
C. 凡士林
D. 羊毛脂
E. 氢化植物油

正确答案：A。二甲硅油

解析：本题考查的是软膏剂的油油脂性基质。对眼睛有刺激性，不宜作为眼膏基质的是二甲硅油（A对）。软膏剂由药物、基质组成。常用基质分为油脂性、水溶性两种类型。油脂性基质主要包括油脂类、类脂类、烃类和硅酮类。1）油脂类：系从动物或植物中获得的高级脂肪酸甘油酯及其混合物。因含有不饱和双键，易氧化酸败，可加入抗氧化剂和防腐剂改善。常用的有动、植物油，氢化植物油（E错）等。植物油常与熔点较高的蜡类熔合制成稠度适宜的基质，如中药油膏常用麻油与蜂蜡熔合为基质。2）类脂类：系高级脂肪酸与高级脂肪醇形成的酯类，其物理性质与油脂类相似。①羊毛脂（D错）：其组成与皮脂分泌物相近，故可提高软膏中药物的渗透性。常与凡士林合用，调节凡士林的渗透性和吸水性。②蜂蜡（B错）：常用调节软膏的稠度或增加稳定性。因含有少量的游离高级脂肪醇而有乳化作用，可作为辅助乳化剂。此类还有虫白蜡、鲸蜡等，主要用于增加基质的稠度。3）烃类：系石油分馏得到的多种高级烃的混合物，大部分为饱和烃类。性质稳定，很少与药物发生作用。不易被皮肤吸收，尤适用于保护性软膏。①凡士林（C错）：具有适宜的稠度和涂展性，且对皮肤与黏膜无刺激性。性质稳定，不酸败，可与大多数药物配伍。②石蜡与液状石蜡：主要用于调节软膏稠度，液状石蜡还可用以研磨药物粉末，使易于基质混匀。4）硅酮类：为有机硅氧化物的聚合物，俗称硅油。常用二甲硅油，为无色澄清的透明油状液体，无臭、无味，化学性质稳定，无毒性，对皮肤无刺激性，不污染衣物，具有良好的润滑作用，易于涂布，能与羊毛脂、硬脂醇、鲸蜡醇、硬脂酸甘油酯等混合。因此常用于乳膏剂，也可与其他油脂类基质合用制成防护性软膏。本品对眼睛有刺激性，不宜作为眼膏基质。